属于三级预防的是
A. 游说进行烟草广告立法
B. 对高血压患者的全面监管
C. 在高危人群中定期检测HIV
D. 残疾患者中假肢、矫正器、轮椅等的应用
E. 定期对成年人进行心血管疾病危险因素评估

正确答案：D。残疾患者中假肢、矫正器、轮椅等的应用

解析：本题考查三级预防。第三级预防又称临床预防或疾病管理，是发生在疾病的症状体征明显表现出来之后。早期，通过适当的治疗缓解症状，预防疾病进一步恶化，预防急性事件的发生和复发，预防合并症和残疾的发生。到了疾病晚期，通过早期发现和管理合并症，对已经发生的残疾进行康复治疗，最大限度的恢复个体的机体功能和社会功能，提高生活质量，延长寿命。例如，残疾患者中假肢、矫正器、轮椅等的应用（D对ABCE错）。